初戴全口义齿时，发现总义齿左右翘动，加力时患者有痛感。可能引起翘动的原因中不包括进入倒凹区基托未缓冲。在下述造成义齿翘动的原因中，首先考虑的原因应是
A. 基托伸展过长
B. 基托变形
C. 印模不准确
D. 模型不准确
E. 与硬区相应的基托组织面未做缓冲

正确答案：E。与硬区相应的基托组织面未做缓冲

解析：本题考查义齿翘动的原因。全口义齿如有左右翘动，上颌义齿首先考虑硬区相应的基托组织面未做缓冲（E对）引起，下颌义齿引起翘动则首先考虑与外斜嵴、下颌隆突相应的基托组织面未做缓冲引起。基托伸展过长（A错）一般引起软组织的疼痛，恶心，还有可能造成固位尚好，但咀嚼食物时，义齿易脱落等；基托变形（B错）、印模不准确（C错）以及模型不准确（D错）时，易造成不能就位。